疾病监测的目的不包括
A. 描述疾病分布
B. 预测疾病流行
C. 验证病因假设
D. 制定预防措施
E. 评价预防效果

正确答案：C。验证病因假设

解析：本题考查疾病监测的目的。疾病监测的目的是：1.描述与健康相关事件的分布特征（A对）和变化趋势：（1）定量评估公共卫生问题的严重性，确定主要公共卫生问题；（2）发现健康相关事件分布中的异常情况，及时调查原因并采取干预措施（D对），有效遏制不良健康事件的发展和蔓延；（3）预测健康相关事件的发展趋势（B对），正确估计卫生服务需求；（4）研究疾病的影响因素，确定高危人群。2.评价公共卫生干预策略和措施的效果（E对）。验证病因假设（C错，为本题正确答案）不是疾病监测的目的。